糖皮质激素诱发和加重感染的主要原因
A. 患者对激素不敏感
B. 激素用量不足
C. 激素能直接促进病原微生物繁殖
D. 激素抑制免疫反应，降低机体抵抗力
E. 使用激素时未能应用有效抗菌药物

正确答案：D。激素抑制免疫反应，降低机体抵抗力

解析：糖皮质激素属于肾上腺皮质激素类，患者对激素不敏感（A错）时，不能用于抗炎、抗休克以及哮喘等的治疗，并不会诱发和加重感染。糖皮质激素诱发和加重感染的药理作用与用量无关（B错），主要是由于糖皮质激素具有免疫抑制的作用（D对），对免疫反应的许多环节都有抑制作用，可抑制巨噬细胞对抗原的吞噬和处理，阻碍淋巴母细胞的增殖，加速致敏淋巴细胞的破坏和解体，使血中淋巴细胞迅速降低，临床可用于变态反应以及组织脏器移植的排斥反应，同时也降低了机体对病原菌的防御能力，细菌容易趁虚而入诱发感染或促使体内原有病灶如结核、化脓性病灶等扩散、加重，必要时可以合并抗菌药使用，来预防和控制感染（E错）。糖皮质激素具有抗炎作用，无抗菌作用，无直接促进病原微生物繁殖的作用（C错）。